有关血氧指标的叙述，下列哪项是不正确的？
A. 血氧容量决定于血液中的Hb浓度及Hb和02的结合能力
B. 血氧饱和度的高低与血液中血红蛋白的量无关
C. 动脉血氧分压仅取决于吸入气中氧分压的高低
D. 血氧含量是指100ml血液实际带氧量
E. 正常动、静脉血氧含量差约5ml/dl

正确答案：C。动脉血氧分压仅取决于吸入气中氧分压的高低

解析：血氧分压为物理溶解于血液中的氧所产生的张力，动脉血氧分压主要取决于吸入气的氧分压和肺的通气与弥散功能（C错，为本题正确答案）。血氧容量取决于血液中Hb的含量及其与O2结合的能力（A对）。血氧饱和度主要取决于血氧分压（B对）。100ml血液中实际含有的氧量称为血氧含量（D对）。正常动、静脉血氧含量差约为5ml/dl（E对）。